一般情况下，有机磷农药在体内的转化主要有氧化和水解两种方式，其结果分别是
A. 氧化使毒作用增强，水解使毒作用减弱
B. 氧化、水解均使毒作用增强
C. 氧化、水解均使毒作用减弱
D. 氧化、水解均不改变毒作用大小
E. 氧化使毒作用减弱，水解使毒作用增强

正确答案：A。氧化使毒作用增强，水解使毒作用减弱